铅抑制血红素合成酶后，体内的锌离子被络合于
A. 原卟啉原
B. 粪卟啉原Ⅲ
C. 原卟啉Ⅸ
D. 卟胆原
E. 尿卟啉原Ⅱ

正确答案：C。原卟啉Ⅸ